女，26岁，半年来无原因认为同事指桑骂槐地议论她，街上行人的举动及电视内容都针对她。为之心情烦躁，不敢上班。该病人的精神症状最可能是
A. 被害妄想
B. 情感脆弱
C. 影响妄想
D. 关系妄想
E. 焦虑

正确答案：D。关系妄想

解析：该病例患者无原因认为同事在议论她，甚至街上行人的举动和电视内容（周围环境所发生的事与其无关）都针对她为关系妄想（D对）。被害妄想的患者坚信自己被某些人或组织进行迫害，如投毒、跟踪、监视、诽谤等，与本例不符（A错）。焦虑的患者表现为顾虑重重、紧张恐惧，坐立不安，严重者可表现为搓手顿足，惶惶不可终日，似有大祸临头的感觉，常伴有心悸、出汗、手抖、尿频等自主神经功能紊乱症状，与本例不符（E错）。